与中骨盆狭窄无关的是
A. 坐骨切迹宽度
B. 骶尾关节活动度
C. 坐骨棘间径
D. 骨盆侧壁倾斜度
E. 骶骨弯曲度

正确答案：B。骶尾关节活动度

解析：真骨盆分3个平面，骨盆入口平面，中骨盆平面和骨盆出口平面。坐骨切迹宽度（P10）（A对）即骶棘韧带宽度，是判断中骨盆是否狭窄的重要指标。坐骨棘间径（P148）（C对）是中骨盆最短的径线，是衡量中骨盆横径的重要径线。骨盆侧壁倾斜度（D对）（不是骨盆倾斜度）越大，先露部越容易经过中骨盆，越有利于分娩。骶骨弯曲度（E对）是指产妇直立时骶骨前面上下端连线与垂直线形成的角度，在40～49°者较适合胎儿通过中骨盆平面。骶尾关节（P10）（B错，为本题正确答案）有一定的活动度，分娩时尾骨后移可加大骨盆出口前后径，为影响骨盆出口平面的因素。